口内形成瘘管多为
A. 根尖囊肿
B. 造釉细胞瘤
C. 颌骨囊肿
D. 根尖肉芽肿
E. 慢性根尖脓肿

正确答案：E。慢性根尖脓肿

解析：本题考查口内形成瘘管的疾病。发生慢性根尖脓肿（E对）时，根尖部的脓液可逐渐穿通骨壁和软组织，形成骨膜下脓肿或黏膜下脓肿，穿破黏膜在口腔前庭排脓，形成瘘管。根尖囊肿（A错）有囊壁包绕的小囊肿，不与外界想通，不形成瘘管。造釉细胞瘤（B错）即成釉细胞瘤，瘤体组织为实性或囊性，都不会形成瘘管。颌骨囊肿（C错）由骨壁包绕，不形成瘘管。根尖肉芽肿（D错）是慢性根尖周炎的主要类型，根尖端有肉芽组织团块，不形成瘘管。